以下哪一肌肉不参与软腭的构成
A. 腭帆提肌
B. 腭帆张肌
C. 咽上缩肌
D. 腭舌肌
E. 腭垂肌

正确答案：C。咽上缩肌

解析：本题考查软腭的构成。咽上缩肌（C错，为本题的正确答案）不参与软腭的构成。咽上缩肌构成咽上部的肌性壁，是咽部的三对咽缩肌之一，不参与软腭的构成。腭肌位于软腭的后2/3，肌肉细小，共计5对：①腭帆提肌（A对）：是软腭的主要肌肉，其作用是上提软腭并参与咽侧壁的内向收缩，在发音时是完成腭咽闭合最重要的肌肉之一。②腭帆张肌（B对）：位于腭帆提肌的前侧和外侧，主要作用是拉紧软腭，也有使咽鼓管开放的功能。③腭舌肌（D对）：主要功能是下降软腭，提高舌根。④腭垂肌（E对）：位于腭咽肌上头的深面，主要作用是牵拉腭垂向上。⑤腭咽肌：位于茎突咽肌的内侧，主要功能是下降软腭，上提咽部。